牙再植后，X线片显示牙根炎症性吸收的时间是
A. 伤后2～4周
B. 伤后1～4个月
C. 伤后5个月
D. 伤后半年
E. 伤后半年以上

正确答案：B。伤后1～4个月

解析：本题考查牙再植后的愈合方式-炎症性吸收。牙再植后，X线片显示牙根炎症性吸收的时间是伤后1～4个月（B对）。牙脱位再植后的愈合方式有三种：牙周膜愈合、骨性粘连和炎症性吸收，炎症性吸收表现为在被吸收的牙根面与牙槽骨之间有炎症性肉芽组织，其中有淋巴细胞、浆细胞和分叶粒细胞，再植前牙体干燥或坏死牙髓的存在都是炎症性吸收的原因，炎症性吸收在受伤后1～4个月即可由X线片显示，表现为广泛的骨透射区和牙根面吸收。